女，35岁。近2个月来食欲增加，出汗增加，怕热，体重下降并易激惹，活动增加。独处时偶尔听到有人议论他，或觉得一些行人对他吐痰等。实验室检查：血T₃、T₄增加，空腹血糖5.5mmo/L。该患者最可能的诊断是
A. 糖尿病所致精神障碍
B. 精神分裂症
C. 躁狂发作
D. 神经性贪食症
E. 甲状腺功能亢进症所致精神障碍

正确答案：E。甲状腺功能亢进症所致精神障碍

解析：该青年女性，近2个月表现为食欲增加，出汗增加，怕热，体重下降（甲亢的临床表现），血T3、T4增加（甲亢指征），诊断为甲亢，易激惹（精神运动性兴奋）为甲亢所致精神障碍的主要表现，活动增加，偶尔听到有人议论他或觉得一些行人对他吐痰等（关系妄想），故最可能的诊断是甲状腺功能亢进症所致精神障碍（E对）。糖尿病患者中最常见的精神障碍是抑郁和焦虑状态，两者可共存或交替出现，本例无此症状，空腹血糖值正常（正常值范围3.9-6.1mmo/L），故不考虑（A错）。神经性贪食患者表现为多食或暴食行为，进食后又因担心发胖而采用各种方法以减轻体重，使得体重变化不明显，无甲亢典型症状，与本例不符（D错）。